水性涂料环境标志产品的基本要求中，产品生产过程中不得人为添加甲醛及其甲醛的聚合物且含量应小于
A. 100mg/L
B. 200mg/L
C. 300mg/L
D. 400mg/L
E. 500mg/L

正确答案：E。500mg/L

解析：本题考查水性涂料环境标志产品的基本要求中，产品生产过程中甲醛及其甲醛的聚合物添加的含量。水性涂料环境标志产品的基本要求中，产品生产过程中不得人为添加甲醛及其甲醛的聚合物且含量应小于500mg/L（E对ABCD错）。